地西泮主要用于治疗的病症是
A. 癫痫大发作
B. 抑郁症
C. 精神分裂症
D. 慢性疼痛
E. 失眠

正确答案：E。失眠